Dane颗粒是
A. 丁型肝炎病毒
B. 乙型肝炎病毒
C. 甲型肝炎病毒
D. 戊型肝炎病毒
E. 丙型肝炎病毒

正确答案：B。乙型肝炎病毒

解析：电镜下HBV感染者的血清中的病毒颗粒可有三种形态，大球形颗粒、小球形颗粒和管型颗粒，其中大球形颗粒又称为Dane颗粒，是指具有感染性的完整的HBV（乙型肝炎病毒）颗粒（B对）。